治疗霍乱的首选药物是
A. 复方磺胺甲基异恶唑
B. 痢特灵
C. 四环素
D. 土霉素
E. 庆大霉素

正确答案：A。复方磺胺甲基异恶唑

解析：治疗霍乱的关键是补充液体和电解质，应用抗菌药物仅作为液体疗法的辅助治疗，目前常用的药物主要有环丙沙星、诺氟沙星、多西环素和复方磺胺甲基异恶唑（A对）。四环素（八版药理学P391）（C错）目前一般不作为首选药，主要是考虑到耐药菌株日益增多以及药物的不良反应。土霉素（八版药理学P390）（D错）与四环素类似，但抗菌效果更差。痢特灵（B错）、庆大霉素（E错）较少用于治疗霍乱。